环境镉污染可致
A. 水俣病
B. 痛痛病
C. 癞皮病
D. 脚气病
E. 克汀病

正确答案：B。痛痛病

解析：镉污染可引起痛痛病（B对）：水俣病为甲基汞严重污染引起（A错）：癞皮病即烟酸缺乏症，是由烟酸缺乏引起（C错）：脚气病即维生素B1缺乏症，由维生素B1（硫胺素）引起（D错）：克汀病是由严重碘缺乏造成的（E错）。